下列符合动物实验伦理要求的是
A. 对医学研究中的低等动物无需考虑人道问题
B. 用尽可能少的实验动物获得尽可能多的实验数据
C. 医学研究的科学性不能以牺牲动物的福利为代价
D. 尽可能用活体动物代替无知觉的实验材料
E. 尽可能用高等动物代替低等动物

正确答案：B。用尽可能少的实验动物获得尽可能多的实验数据

解析：动物实验应遵循的伦理原则包括：替代、减少、优化和责任。替代是指使用没有知觉的实验材料代替活体动物（D错），或使用低等动物替代高等动物进行试验（E错）。减少就是在动物实验时尽量减少动物的使用量，使用较少量的动物获取同样多的试验数据或使用一定数量的动物能获得更多的试验数据（B对）。优化是指在必须使用动物进行实验时，尽量减少非人道程序对动物的影响范围和程度（A错）。动物福利是指人类应该避免对动物造成不必要的伤害，反对并防止虐待动物，让动物在康乐的状态下生存”（C错）。